能调通水道的是
A. 肝
B. 心
C. 脾
D. 肺
E. 肾

正确答案：D。肺

解析：本题考查的是五脏的生理的功能。能调通水道的是肺（D对）。五脏，指心、肺、脾、肝、肾。五脏的生理功能是：（一）心（B错）的生理功能主要有两方面：一是主血脉，二是主神明。（二）肺的生理功能，包括肺主气、司呼吸，主宣发肃降，通调水道，朝百脉而主治节。（三）脾（C错）的生理功能主要有两方面：一是主运化，二是主统血。（四）肝（A错）的生理功能主要有两方面：一是主疏泄，二是藏血。（五）肾（E错）的生理功能主要有三方面：一是藏精，主生长、发育与生殖；二是主水；三是主纳气。